透析患者服用磷结合剂-碳酸钙时应注意的事项有
A. 必须在两餐间服用
B. 必须在进食时服用
C. 必须在晨起时服用
D. 必须与铁剂同服
E. 必须控制用量，否则易出现高钙血症

正确答案：B、E。必须在进食时服用；必须控制用量，否则易出现高钙血症

解析：本题考查特殊人群用药。健康的肾脏可以清除额外的磷，并将其从尿液排出。但是，磷不能通过透析被充分地清除，因而蓄积于血液中，出现高磷血症。长期高磷血症还会导致心脏、血管的钙化，易出现心力衰竭、心律失常等并发症。多数腹膜透析患者都服用“磷结合剂”类的碳酸钙片，目的是为了防止过多的磷从胃肠道吸收。注意必须在进食的同时服用（B对AC错），否则无效；服用量大时易出现高钙血症（E对）。铁剂帮助身体合成红细胞。不要在服用钙剂的同时服用铁剂（D错），因为二者可互相络合而不能发挥药效。